乳牙深龋，去龋未净意外露髓后最好采用
A. 干髓术
B. 直接盖髓术
C. 间接盖髓术
D. 牙髓切断术
E. 根管治疗

正确答案：D。牙髓切断术

解析：本题考查乳牙牙髓治疗的方法。冠髓已感染，乳牙根髓可能尚有活力，因此可行冠髓切断术（D对），将有炎症的冠髓切除保留根髓。乳牙去龋未净时的意外露髓，其冠髓已被感染，不宜行直接盖髓术（B错），否则会引起化脓性牙髓炎等严重并发症。干髓术（A错）用于治疗全部牙髓坏死的乳牙牙髓炎，不适用龋损未去净意外露髓的乳牙。间接盖髓术用于治疗深龋去净腐质未露髓的患牙（C错）。根管治疗（E错）用于治疗不可复性牙髓炎和根尖周炎等。